进行方差分析时，数据应满足
A. 独立性、正态性、大样本
B. 独立性、正态性、方差齐性
C. 独立性、方差齐性、大样本
D. 独立性、正态性、平行性
E. 正态性、方差齐性、大样本

正确答案：B。独立性、正态性、方差齐性